在血浆蛋白电泳中，泳动最慢的蛋白质是
A. 清蛋白
B. α1-球蛋白
C. α2-球蛋白
D. γ-球蛋白
E. β-球蛋白

正确答案：D。γ-球蛋白

解析：电泳是最常用的分离蛋白质的方法，可将血浆蛋白分成五条区带：清蛋白、α₁-球蛋白、α₂-球蛋白、β-球蛋白、γ-球蛋白。其中清蛋白（A错）的分子量最小，泳动也最快；γ-球蛋白（E对）的分子量最大，泳动最慢。